关于恒牙的描述，正确的是
A. 有20个
B. 磨牙常有1个牙根
C. 前磨牙常有1个牙根
D. 切牙可有2个牙根
E. 尖牙可有2个牙根

正确答案：C。前磨牙常有1个牙根

解析：恒牙有32个(A错)，乳牙有20个，磨牙中前磨牙常有1个牙根(C对)，而下颌磨牙有2个牙根，上颌磨牙有3个牙根(B错)，切牙和尖牙只有一个牙根(DE错)。